ABS对动物各系统与器官的毒性主要包括对肝功能的影响，可引起脂代谢紊乱。正确的是
A. 胆固醇降低
B. 磷脂降低
C. 甘油三酸酯降低
D. 磷脂中棕榈酸升高
E. 花生四烯酸降低

正确答案：C。甘油三酸酯降低

解析：本题考查ABS对动物肝功能的影响。ABS对动物各系统与器官的毒性主要包括对肝功能的影响，可引起脂代谢紊乱。表现为血清胆固醇和磷脂增高，甘油三酸酯降低（C对ABDE错）。磷脂中棕榈酸、油酸廿碳六烯酸组分降低而花生四烯酸升高。